超声检查在口腔颌面部适用于
A. 确定有无占位性病变
B. 确定囊性或实性肿物
C. 为评价肿瘤性质提供信息
D. 确定深部肿物与邻近重要血管的关系
E. 以上均适用

正确答案：E。以上均适用

解析：本题考查超声检查。超声检查可以确定病变的大小、深浅，为评价肿瘤性质提供信息（C对）。超声在口腔颌面部主要用于唾液腺、下颌下和颈部肿块的检查，以确定有无占位性病变（A对），确定囊性或实性肿物（B对）。B型超声准确性较高，且能分辨深部肿瘤和邻近重要血管的关系（D对）。（ABCD均对，故E为本题的正确答案）。